男孩，1岁3个月。面色苍黄2个月，原可独走，现站立不稳，生后母乳喂养，未添加辅食。查体：表情呆滞，四肢抖动，舌苔薄，呈地图状。血常规：Hb88g/L，RBC2.1×10¹²/L。为明确诊断，首选的检查是
A. 血清叶酸，维生素B₁₂测定
B. 血清铁蛋白测定
C. 血清钙、磷、碱性磷酸酶测定
D. 血苯丙氨酸测定
E. 头颅CT

正确答案：A。血清叶酸，维生素B₁₂测定

解析：患儿1岁3个月，生后母乳喂养，未添加辅食（维生素B12摄入量不足），面色苍黄，站立不稳，表情呆滞，四肢抖动，舌苔薄，呈地图状（巨幼贫患儿典型临床表现），血常规：Hb88g/L，RBC2.1×10¹²/L（提示贫血）。根据患儿年龄、临床表现、体征及血常规，最可能的诊断是营养性巨幼细胞性贫血。叶酸、维生素B12参与机体DNA合成，缺乏导致巨幼细胞性贫血，测定血清维生素B₁₂或叶酸水平可协助确诊（A对）。血清铁蛋白测定（B错）是去铁蛋白和核心Fe3+的复合物，为机体铁的储存形式，用于缺铁性贫血的诊断及疗效评价。血清钙、磷、碱性磷酸酶测定（C错）用于维生素D缺乏性佝偻病的诊断及治疗疗效评价，患儿血清钙、磷降低，而碱性磷酸酶高于正常（P80）。血苯丙氨酸测定（D错）用于苯丙酮尿症的确诊。